正常情况下，血中酮体含量约为
A. 0.01～0.2mmol/L
B. 0.02～0.3mmol/L
C. 0.03～0.4mmol/L
D. 0.03～0.5mmol/L
E. 0.04～0.5mmol/L

正确答案：D。0.03～0.5mmol/L

解析：正常情况下，血中酮体含量很少，约为0.03～0.5mmol/L（0.5～5mg/dl）。掌握“脂肪的分解代谢”知识点。